指天然形成的，未被人为活动影响的自然环境条件是指
A. 次生环境
B. 继生环境
C. 原生环境
D. 社会环境
E. 中心环境

正确答案：C。原生环境

解析：原生环境是指天然形成的，未被人为活动影响的自然环境条件。掌握“环境卫生与职业卫生”知识点。